刺激胰岛素分泌的最主要因素是
A. 胃泌素释放
B. 迷走神经兴奋
C. 血糖浓度升高
D. 血氨基酸浓度升高
E. 胰高血糖素释放

正确答案：C。血糖浓度升高